男，7岁，突发寒战，髙热，右膝下方剧痛3天，查体T39.8℃，P86次/分，R25次/分，BP110/60mmHg。烦躁不安，右膝关节呈半屈曲状，拒动，右小腿近端皮温高，肿胀不明显，压痛阳性。早期确诊最可靠的是
A. 血常规
B. 局部分层穿刺
C. CT
D. X线
E. 体格检查

正确答案：B。局部分层穿刺

解析：局部脓肿分层穿刺（B对）抽出混浊液体或血性液可作涂片检查与细菌培养，涂片中发现多是脓细胞或细菌即可明确诊断。血常规（A错）白细胞计数增高一般都在10×10⁹/L以上，中性粒细胞可占90%以上，提示感染；CT（C错）检查较X线平片可以提前发现骨膜下脓肿，但对小的骨脓肿仍难以显示，无法确诊。X线（D错）起病后14天内的X线检查往往无异常发现，用过抗生素的病例出现X线表现的时间可以延迟至1个月左右，故早期不能确诊。